据《素问》“人卧血归”的脏是
A. 肝
B. 心
C. 脾
D. 肺
E. 肾

正确答案：A。肝

解析：该题主要考查肝藏血的生理功能。《素问五藏生成》说：“人卧则血归于肝”唐代王冰注解说：“肝藏血，心行之，人动则血运于诸经，人静则血归于肝脏何者肝主血海故也。”故人卧则血归于肝（A对）。